功善引血下行的药物是
A. 莪术
B. 牛膝
C. 延胡索
D. 川芎
E. 当归

正确答案：B。牛膝

解析：牛膝的功效是逐瘀通经，补肝肾，强筋骨，利尿通淋，引血下行（B对）。莪术（A错）的功效是破血行气，消积止痛。延胡索（C错）的功效是活血，行气，止痛。川芎（D错）的功效是活血行气，祛风止痛。当归（E错）的功效是补血活血，调经止痛，润肠通便。